肠内营养最常出现的并发症是
A. 胆汁淤积
B. 胆石形成
C. 误吸
D. 肠源性感染
E. 肝酶谱升高

正确答案：C。误吸

解析：肠内营养的并发症主要包括误吸（C对）、腹胀腹泻。临床上肠内营养使用最多的方法为鼻胃/十二指肠、鼻空肠置管，导管自鼻孔插入，经由咽部，通过食管到达胃、十二指肠或空肠，若固定或使用不当，很容易发生误吸。胆汁淤积（A错）、胆石形成（B错）、肠源性感染（D错）、肝酶谱升高（E错）均是肠外营养的并发症。